川芎除活血行气外，又能
A. 疏肝解郁
B. 祛风止痛
C. 止咳平喘
D. 利尿通淋
E. 清心除烦

正确答案：B。祛风止痛

解析：本题考查的是川芎的功效。川芎除活血行气外，又能祛风止痛（B对）。川芎：【功效】活血行气，祛风止痛。月季花：【功效】活血调经，疏肝解郁（A错）。桃仁：【功效】活血祛瘀，润肠通便，止咳平喘（C错）。牛膝：【功效】活血通经，利尿通淋（D错），引血下行，补肝肾，强筋骨。丹参：【功效】活血祛瘀，通经止痛，清心除烦（E错），凉血消痈。